可吸入性纤维粉尘是指
A. 直径＞3㎛，长度＜5㎛
B. 直径＞3㎛，长度≥5㎛
C. 直径＜3㎛，长度＜5㎛
D. 直径＜3㎛，长度≥5㎛
E. 直径＜3㎛，长度≥9㎛

正确答案：D。直径＜3㎛，长度≥5㎛

解析：本题考查可吸入性纤维的概念。可吸入性纤维是指直径＜3㎛、长度≥5㎛的纤维（D对ABCE错）。